能清火生津的药是
A. 党参
B. 人参
C. 西洋参
D. 太子参
E. 刺五加

正确答案：C。西洋参

解析：本题考查的是西洋参的功效。能清火生津的药是西洋参（C对）。西洋参：【功效】补气养阴，清热生津。党参（A错）：【功效】补中益气，生津养血。人参（B错）：【功效】大补元气，补脾益肺，生津止渴，安神益智。太子参（D错）：【功效】补气生津。刺五加（E错）：【功效】补气健脾，益肾强腰，养心安神，活血通络。